属于黏膜相关淋巴组织的免疫器官是
A. 淋巴细胞
B. 脾脏
C. 胸腺
D. 淋巴结
E. 阑尾

正确答案：E。阑尾